精神药品
A. 生马钱子
B. 氢溴酸东莨菪碱
C. 川芎
D. 1%毛果芸香碱滴眼剂
E. 艾司唑仑

正确答案：E。艾司唑仑